包被气管的是
A. 颈浅筋膜
B. 颈深筋膜浅层
C. 颈深筋膜中层
D. 颈脏器筋膜
E. 颈中筋膜浅层

正确答案：D。颈脏器筋膜

解析：本题考查颈部分区、颈筋膜层次及下颌下三角解剖特点。颈部筋膜由浅入深可分为五层：1.颈浅筋膜；2.颈深筋膜浅层；3.颈深筋膜中层；4.颈脏器筋膜；5.椎前筋膜（颈深筋膜深层）。颈脏器筋膜（D对）包被颈部脏器，如喉、气管、甲状腺、咽及食管等。课本中颈部筋膜分为三层时，中层的内脏筋膜包被气管，但结合选项，颈脏器筋膜更为确切，为最优选项。